前庭阶与鼓阶的交通
A. 颅骨
B. 第二鼓膜
C. 蜗孔
D. 前庭窗
E. 基底膜

正确答案：C。蜗孔

解析：前庭阶和鼓阶在蜗顶处借蜗孔（C对）彼此相通。蜗孔在蜗顶处，由骨螺旋板和膜螺旋板与蜗轴围成，是前庭阶和鼓阶的唯一通道。基底膜（E错）和骨螺旋板组成下壁，与鼓阶相隔。第二鼓膜（B错）是封闭蜗窗的。前庭窗（D错）在活体，由镫骨底及其周缘的韧带封闭。